适用于轻中度高血压伴肾功能不良的药物是
A. 肼屈嗪
B. 硝普钠
C. 依那普利
D. 哌唑嗪
E. 可乐定

正确答案：D。哌唑嗪

解析：哌唑嗪应用于：①各型高血压：可适用于轻、中、重度的高血压，亦可用于合并前列腺肥大的高血压患者②慢性心功能不全。对突触前膜α₂受体几无阻断作用，故在降压时无反射性心率加快与肾素分泌，对肾血流量和肾小球滤过率也无明显影响（D对）。肼屈嗪临床适用于中、重度高血压，常与其他降压药联用（A错）。硝普纳临床应用于高血压急症：如高血压危象、高血压脑病、恶性高血压、嗜铬细胞瘤引起的高血压，也可用于麻醉时控制性降压（B错）。依那普利应用于各型原发性高血压及肾性高血压，充血性心力衰竭（C错）。可乐定可用于治疗中度高血压，适用于兼有溃疡病的高血压及肾性高血压患者。还可作为吗啡类成瘾药物的戒毒药（E错）。